诊断肺栓塞的金标准是
A. 胸片
B. CT
C. 超声心动图
D. 肺通气/灌注（V/Q）显象
E. 肺血管造影

正确答案：E。肺血管造影

解析：肺血管造影可直接显示肺血管栓塞部位与程度，及时高效，敏感性与特异性均高，是诊断肺栓塞的金标准（E对），但肺血管造影是有创性检查，应严格掌握适应症。随着多排CT肺血管造影的应用，肺动脉造影的这种地位已经被逐渐取代。胸片（A错）、超声心动图（C错）是对疑诊肺血管栓塞病人进行的排除性诊断，不是确诊的手段。CT（B错）和肺通气/灌注（V/Q）显象（D错）是对疑诊病例进一步明确诊断的检查方法，但CT只能准确发现段以上肺动脉内的血栓，对肺段以下的肺动脉内的栓塞不敏感，肺通气/灌注（V/Q）显象对于远端肺栓塞诊断价值更高。